预防N-亚硝基化合物危害人体健康的措施是
A. 改善食品加工方法
B. 暴晒污染食品
C. 增加维生素C的摄入
D. 多施钼肥
E. 以上都是

正确答案：E。以上都是